患者，女性，43岁，患甲亢3年，需行甲状腺部分切除术，正确的术前准备是
A. 术前2周给丙基硫氧嘧啶+普萘洛尔
B. 术前2周给丙基硫氧嘧啶+小剂量碘剂
C. 术前2周给丙基硫氧嘧啶+大剂量碘剂
D. 术前2周给丙基硫氧嘧啶
E. 术前2周给卡比马唑

正确答案：C。术前2周给丙基硫氧嘧啶+大剂量碘剂